我国较系统的卫生服务研究起始于
A. 1980
B. 1981
C. 1982
D. 1985
E. 1991

正确答案：B。1981

解析：本题考查我国较系统的卫生服务研究起始时间。我国开展较系统的卫生服务研究起始于1981年（B对ACDE错）。